患者，女性，63岁，有长期吸烟史，慢性咳嗽多年，近两三个月刺激性咳嗽并持续痰中带血，抗炎镇咳治疗后无明显疗效，X线显示右侧第二肋间有结节致密影，2.5cm×3.5cm大小，呈分叶状，边缘有短毛刺，右肺门结节增大。应首先考虑的诊断是
A. 结核球
B. 肺门淋巴结结核
C. 炎性假瘤
D. 纵隔淋巴瘤
E. 支气管肺癌

正确答案：E。支气管肺癌

解析：患者有长期吸烟史，慢性咳嗽多年，现咳嗽带血，X线有致密影，且边界不清首先考虑肺癌，及早进行后续检查（E对）。结核球一般为单个、直径2cm以上的由纤维组织包绕干酪样结核病变或阻塞性空洞被干酪物质充填而形成的球形病灶，呈圆形、椭圆形或分叶状，多位于肺的上叶；一般表现为球形块状影，轮廓清楚，密度不均可含有钙化灶或透光区，周围可有散在的纤维增殖性病灶，常称为“卫星灶”。是相对稳定的病灶，可长期保持静止状态，但当机体抵抗力降低时，病灶可恶化进展（A错）。肺门淋巴结结核常见于儿童和少年，临床症状为低热、盗汗、消瘦、萎靡，偶有持续高热、颈部淋巴结肿大者（B错）。眼眶炎性假瘤临床表现主要有眼痛、眼睑和结膜红肿、眼球突出、眼球运动障碍及视力下降等。用皮质类固醇等抗炎治疗可使病情缓解，但易复发（C错）。纵隔淋巴瘤早的表现多是浅表淋巴结呈无痛性进行性肿大，常缺乏全身症状，进展较慢。约有60%原发于颈淋巴结，原发于锁骨上、腑下及腹股沟淋巴结的较少见。初起时，淋巴结柔软，彼此不粘连，无触痛。后期增大迅速，可粘连成一巨大肿块（D错）。